小儿厌食脾失健运证的治法是
A. 调和脾胃，运脾开胃
B. 健脾益气，佐以温中
C. 滋脾养胃，佐以助运
D. 运脾化湿，消积开胃
E. 补脾开胃，消食助运

正确答案：A。调和脾胃，运脾开胃

解析：小儿厌食从脾胃方面辨别分两方面，一方面是以运化功能失健为主，另一方面是以脾胃气阴亏虚为主。小儿厌食脾失健运证治宜调和脾胃，运脾开胃（A对）。健脾益气，佐以温中为小儿厌食脾胃气虚证伴大便溏薄的治法（B错）。滋脾养胃，佐以助运为小儿厌食脾胃阴虚证的治法（C错）。运脾化湿，消积开胃为湿邪困脾，饮食积滞的治法，非脾失健运的治法（D错）。小儿厌食脾失健运证脾尚未虚，补脾开胃，消食助运为脾虚食少，饮食停滞的治法（E错）。